男，45岁。HbsAg阳性10年，乏力、纳差、尿黄7天。查体：巩膜中度黄染，肝肋下1cm，质软。实验学检查：ALT460U/L，TBil84μmol/L，HBV-DNA6×10⁶拷贝/ml，抗HAVIgM（-），抗HEV（-），抗HCV（-）。该患者最重要的治疗药物
A. 替诺福韦酯
B. 利巴韦林
C. 促肝细胞生长素
D. 异甘草酸美注射液
E. 茵栀黄口服液

正确答案：A。替诺福韦酯

解析：中年男性患者，HBsAg阳性10年（表示慢性HBV感染）。乏力、纳差、尿黄7天。查体：巩膜中度黄染，肝肋下1cm（HbsAg感染急性期的症状和体征）。实验学检查：ALT460U/L（正常值＜40U/L，提示存在肝功能损伤），TBil84μmol/L（正常高值为17.1mmol/L），HBV-DNA6×10⁶拷贝/ml（提示HBV感染），抗HAVIgM（-），抗HEV（-），抗HCV（-）。综合该患者的病史、临表、体查、实验室检查，该患者诊断考虑为慢性乙肝急性感染期。HBV感染所致的慢性乙肝，最重要的是抗病毒治疗，药物主要有核苷类似物（如替诺福韦酯）（A对）。利巴韦林（B错）与干扰素联合用于治疗HCV感染。